以被动扩散方式吸收的药物有
A. 维生素B
B. 阿司匹林
C. 对乙酰氨基酚
D. 维生素C
E. 钙剂

正确答案：B、C。阿司匹林；对乙酰氨基酚

解析：本题考查药物的吸收方式。阿司匹林（B对）和对乙酰氨基酚（C对）是以被动扩散的方式吸收进入人体的。维生素B（A错）、维生素C（D错）和钙剂（E错）均是以主动转运的方式进入人体。